液体物料的一步制粒应采用
A. 挤压过筛制粒法
B. 流化沸腾制粒法
C. 搅拌制粒法
D. 干法制粒法
E. 喷雾干燥制粒法

正确答案：E。喷雾干燥制粒法